既能疏散风热，又能清热解毒的中药有
A. 金银花
B. 连翘
C. 板蓝根
D. 蒲公英
E. 菊花

正确答案：A、B、E。金银花；连翘；菊花

解析：本题考查金银花、菊花、连翘的功效。既能疏散风热，又能清热解毒的中药有金银花（A对）、连翘（B对）、菊花（E对）。金银花【功效】清热解毒，疏散风热。连翘【功效】清热解毒，疏散风热，消肿散结，利尿。菊花【功效】疏散风热，平肝明目，清热解毒。板蓝根（C错）【功效】清热解毒，凉血，利咽。蒲公英（D错）【功效】清热解毒，消痈散结，利湿通淋。